葡萄糖注射液中的特殊杂质是
A. 对氨基酚
B. 还原糖
C. 氨
D. 二乙胺
E. 二氧化碳

正确答案：E。二氧化碳